一篇发表的论文中报告，一项病例对照研究发现吸烟与肺癌的关联度OR及可信区间为2.5（0.8～6.0）。根据该结果，可以得出的推论是
A. 吸烟与肺癌无关
B. 吸烟与肺癌有关，本研究结果错误
C. 该研究未得出吸烟与肺癌有统计学意义的关联
D. 该研究的样本量不足
E. 该研究对照选择不合理

正确答案：C。该研究未得出吸烟与肺癌有统计学意义的关联